消化道和肝脏淤血，软组织水肿考虑的疾病
A. 左心衰竭
B. 右心衰竭
C. 肝硬化
D. 心律失常
E. 动脉硬化

正确答案：B。右心衰竭

解析：右心衰竭（B对）以体循环淤血为主要表现，引起消化道和肝脏淤血，由于体静脉压力升高使软组织水肿。左心衰竭（A错）以肺循环淤血及心排血量降低为主要表现，主要症状包括不同程度的呼吸困难，咳嗽、咳痰、咯血，乏力、头晕、少尿以及肾功能损害症状，典型体征为肺部湿性啰音等。肝硬化（C错）代偿期时大部分患者无症状或症状较轻，可有腹部不适、消化不良等症状，失代偿期主要为肝功能减退和门静脉高压两类临床症状，多伴有腹水。心律失常（D错）指心脏活动的起源和（或）传导障碍导致心脏搏动的频率和（或）节律异常，胃肠道症状少见。动脉硬化（E错）是动脉的一种非炎症性病变，可使动脉管壁增厚、变硬，失去弹性、管腔狭窄，与本题不符。